颈侧颌下有肿块如豆，累累如串珠，称为
A. 悬饮
B. 气胸
C. 瘿瘤
D. 鸡胸
E. 瘰疬

正确答案：E。瘰疬

解析：悬饮证见胁下胀满，咳嗽或唾涎时两胁引痛，甚则转身及呼吸均牵引作痛，心下痞硬胀满，或兼干呕、短气，头痛目眩（A错）。气体进入胸膜腔，造成积气状态，称为气胸（B错）。瘿是甲状腺疾病的总称，指颈前喉结两侧肿大的一类疾病（C错）。鸡胸是一种与漏斗胸相反的、胸骨向前凸起的胸廓畸形（D错）。瘰疬是一种发生于颈部的慢性化脓性疾病。因其结核多枚，累累如串珠状，故名瘰疬（E对）。